下列乳腺癌类型中常表现为粉刺癌的是
A. 浸润性小叶癌
B. 浸润性导管癌
C. 导管内原位癌
D. 小叶原位癌
E. 髓样癌

正确答案：C。导管内原位癌

解析：导管内原位癌中的高级别DCIS往往由较大的多形性细胞构成，核仁明显、核分裂象常见，管腔内常出现伴有大量坏死碎屑的粉剌样坏死，即表现为粉刺癌（C对）。浸润性小叶癌癌细胞呈单行串珠状或细条索状浸润于纤维间质之间（A错）。浸润性导管癌，癌细胞排列成巢状、团索状，或伴有少量腺样结构（B错）。小叶原位癌表现为扩张乳腺小叶末梢导管和腺泡内充满呈实体排列的肿瘤细胞，小叶结构尚存（D错）。髓样癌表现为大量癌细胞巢，间质少，伴有大量淋巴细胞浸润（E错）。